催化产生丙酮酸的是
A. 转氨酶
B. 乳酸脱氢酶
C. HMG-CoA还原酶
D. 丙酮酸羧化酶
E. 琥珀酸CoA羧化酶

正确答案：B。乳酸脱氢酶

解析：催化产生丙酮酸的是丙酮酸激酶和乳酸脱氢酶（B对）。丙酮酸可由磷酸烯醇式丙酮酸在丙酮酸激酶的催化下生成；也可由乳酸在乳酸脱氢酶的催化下生成。丙酮酸是丙氨酸的α-酮酸，丙氨酸和α-酮戊二酸可以在谷丙转氨酶的催化下生成谷氨酸和丙酮酸，但选项中的转氨酶（A错）并没有特指谷丙转氨酶，因此A不是最佳选项。HMG-CoA还原酶（C错）是胆固醇合成的关键酶，丙酮酸羧化酶（D错）催化的是丙酮酸生成草酰乙酸。